苦参除清热燥湿外，又能
A. 祛风杀虫
B. 消痈排脓
C. 散结解毒
D. 清泄肺热
E. 凉血消肿

正确答案：A。祛风杀虫

解析：本题考查苦参的功效。苦参除清热燥湿外，又能祛风杀虫（A对）。苦参【功效】清热燥湿，杀虫止痒，利尿。鱼腥草【功效】清热解毒，排脓消痈（B错），利尿通淋。玄参【功效】清热凉血，滋阴降火，解毒散结（C错），润肠。清热药：按其性能功效及临床应用，常将本类药物分为清热泻火药、清热燥湿药、清热凉血药、清热解毒药、清虚热药五类。其中，清热泻火药性味多甘寒或苦寒，功主清泄实热郁火，主治外感热病气分高热证，以及肺热（D错）、胃火、肝火、心火等脏腑火热证等。紫花地丁【功效】清热解毒，凉血消肿（E错）。